连续生产的原料药的一个批号为
A. 以同一配液罐一次所配置的药液所生产的均质产品
B. 以同一批原料药在同一连续生产周期内生产的均质产品
C. 在成型或分装前使用同一台混合设备一次混合量所生产的均质产品
D. 在一定时间间隔内生产的在规定限度内的均质产品
E. 在灌装（封）前经最后混合的药液所生产的均质产品

正确答案：D。在一定时间间隔内生产的在规定限度内的均质产品